某城镇一电影院春节期间放映新片，场场爆满，每场3小时，场次间隔仅15分钟，而且管理混乱，吃东西、抽烟相当普遍。大多数观众散场后均感到疲乏、头晕、头痛，甚至恶心不适等，其原因最可能是
A. CO中毒
B. 室内通风不好，CO浓度过高
C. 放映时间过长
D. 电影院建筑质量差
E. 传染病流行

正确答案：B。室内通风不好，CO浓度过高

解析：本题考查引起观众感到不适等症状的原因。由于该电影院场场爆满，而且管理混乱，观众吃东西、抽烟相当普遍，大多数观众散场后均感到疲乏、头晕、头痛，甚至恶心不适等，所以最可能的原因是室内通风不好，CO浓度过高（B对ACDE错）。CO是一种有毒气体，它是一种无色、无味的气体，它的毒性比空气重，容易积聚在室内，如果室内通风不好，CO浓度就会过高，从而导致观众出现一系列不适症状。